外阴阴道假丝酵母菌的主要感染方式是
A. 内源性感染
B. 性生活直接传播
C. 经接触感染衣物传播
D. 经血液传播
E. 垂直传播

正确答案：A。内源性感染

解析：外阴阴道病念珠菌又称假丝酵母菌，其主要传播途径为内源性感染（A对），假丝酵母菌除作为条件致病菌寄生阴道外，也可寄生于人的口腔、肠道，一旦条件适宜，这3个部位的假丝酵母菌可互相传染，称为内源性传染。少部分可通过性生活直接传播（B错），极少经接触感染的衣物（C错）间接传播，但不能通过血液传播（D错）和垂直传播（E错）。